溶栓机制是与内源性纤维蛋白溶酶原结合成复合物，促使纤维蛋白溶酶原转变为纤溶酶，导致血栓溶解的药物是
A. 香豆素
B. 肝素
C. 维生素K
D. 链激酶
E. 氯化钾

正确答案：D。链激酶

解析：现用基因工程技术制备重组链激酶。其溶解血栓的机制是与内源性纤维蛋白溶酶原结合成复合物，并促使纤维蛋白溶酶原转变为纤溶酶，纤溶酶迅速水解血栓中纤维蛋白，导致血栓溶解。掌握“肝素、香豆素、阿司匹林和链激酶”知识点。